哪个牙的尖顶偏远中
A. 上颌乳尖牙
B. 下颌乳尖牙
C. 上颌第一双尖牙
D. 上颌第一乳磨牙
E. 下颌第一乳磨牙

正确答案：A。上颌乳尖牙

解析：本题考查牙的尖顶偏远中的牙齿。上颌乳尖牙（A对）的尖顶偏远中。全口牙中，上颌乳尖牙和上颌第一前磨牙（即上颌第一双尖牙）的颊尖（C错）偏远中。上颌乳尖牙的近中斜缘长于远中斜缘，尖顶偏远中，是其最主要的解剖特征。下颌乳尖牙（B错）远中斜缘长于近中斜缘，牙尖偏近中。上颌第一乳磨牙（D错）颊尖微突，略偏近中。下颌第一乳磨牙（E错）牙尖略偏近中。